5岁幼儿嗜食坚果，某日该儿童出现眩晕，恶心，呕吐等症状来到医院就诊。来院后病情继续恶化，出现神志改变，惊厥、查体：瞳孔散大，对光反射迟钝，询问家长得知，患儿发病前服用过某种坚果。若医师诊断正确，患儿病情又进一步发展，可能出现的严重后果是
A. 黏膜出血
B. 呼吸麻痹
C. 中毒性肝炎
D. 急性肾衰竭
E. 中毒性休克

正确答案：B。呼吸麻痹

解析：本题考查的是中药饮片的不良反应。儿童出现眩晕，恶心，呕吐等症状来到医院就诊。来院后病情继续恶化，出现神志改变，惊厥、查体：瞳孔散大，对光反射迟钝，询问家长得知，患儿发病前服用过某种坚果。若医师诊断正确，患儿病情又进一步发展，可能出现的严重后果是呼吸麻痹（B对）。苦杏仁不良反应表现：苦杏仁的主要成分苦杏仁苷是其有效成分也是中毒成分，误服过量苦杏仁可发生氢氰酸中毒，使延髓等生命中枢先抑制后麻痹，并抑制细胞色素氧化酶的活性而引起组织窒息。临床表现为眩晕、心悸、恶心、呕吐等中毒反应，重者出现昏迷、惊厥、瞳孔散大、对光反应消失，最后因呼吸麻痹而死亡。中毒性肝炎（C错）为胆矾的不良反应表现。胆矾的不良反应表现：①消化系统：流涎、恶心、呕吐、腹痛、腹泻、呕血、便血等，口涎、呕吐物、粪便多呈蓝绿色，口中有特殊金属味；黄疸、中毒性肝炎等症状。②血液系统：溶血性贫血。③泌尿系统：蛋白尿、血尿、少尿、无尿、氮质血症、急性肾功能衰竭或尿毒症等。④循环系统：血管麻痹、血压下降。铜离子对心脏损害可引起中毒性心肌炎，表现心动过速、心律失常及心力衰竭。⑤神经系统：头痛头晕、全身乏力，严重者出现脑水肿、痉挛、神经麻痹、谵妄、意识障碍等中毒性脑炎症状。急性肾衰竭（D错）为雷公藤的不良反应表现。雷公藤的不良反应表现：①消化系统：腹痛、腹泻，恶心、呕吐，食欲不振，肝损害，少数可致伪膜性肠炎，严重者可致消化道出血。②血液系统：血小板、白细胞、血红蛋白减少，严重者可发生急性粒细胞减少、再生障碍性贫血等。③生殖系统：对男性患者雷公藤可抑制精细胞中酶的活性，导致精子产生和成熟发生障碍，表现为精子数量显著减少，长期用药还会导致性欲减退、睾丸萎缩；对女性患者雷公藤可抑制其卵巢功能，表现为月经紊乱、经量减少、卵巢早衰。④神经系统：头晕、乏力、失眠、听力减退、嗜睡、复视，还可引起周围神经炎。⑤泌尿系统：主要表现为急性肾功能衰竭，服药后迅速出现或逐渐发生少尿、水肿、血尿、蛋白尿、管型尿、腰痛或伴肾区叩击痛，常常发生于过量中毒时。⑥心血管系统：心悸、胸闷、心动过缓、气短、心律失常、心电图改变（ST-T改变），严重者可见血压急剧下降，个别出现室颤、心源性休克而死亡。⑦皮肤黏膜损害：皮肤糜烂、溃疡、斑丘疹、荨麻疹、瘙痒等。不良反应为黏膜出血（A错）与中毒性休克（E错）的中药，2022年考试指南未明确说明。